当收缩压处于90mmHg，神志尚清，判断失血量的多少
A. 400-800
B. 800-1600
C. ＞1600
D. 400-200
E. 200-100

正确答案：B。800-1600

解析：按照休克的程度可分为轻度休克、中度休克、重度休克。收缩压处于90mmHg，神志尚清属于中度休克的临床表现，估计失血量：20%-40%（800-1600ml）（B对）；轻度休克的收缩压正常或稍升高、舒张压增高、脉压减小，神志清楚，估计失血量：20%以下（800ml以下）（A错）；重度休克的收缩压在70mmHg以下或测不到，意识模糊，估计失血量：40%以上（1600ml以上）（C错）。